男，28岁。心悸、无力、手颤抖3个月，大便每日2～3次，不成形。体重下降5kg，1周前诊断为甲状腺功能亢进症，尚未治疗，昨晚饮白酒半斤，呕吐1次，晨起醒来发现双下肢不能活动。下肢不能活动的紧急处理是
A. 口服大剂量β受体阻滞剂
B. 静脉补钾
C. 口服甲硫氧嘧啶
D. 注射B族维生素
E. 静脉滴注氢化可的松

正确答案：B。静脉补钾

解析：患者为青年男性，有甲亢病史，呕吐后发现双下肢不能活动，提示可能出现甲亢性周期性瘫痪。（甲亢性周期性瘫痪是指甲亢病人出现的肢体双侧对称性瘫痪，下肢较重，在亚洲青壮年男性中多见。通常由低血钾引发。）甲亢时，过多的甲状腺激素可促进Na⁺-K⁺泵活性，使K⁺向细胞内转移，导致血钾降低，进一步引发周期性瘫痪。因此对周期性瘫痪的紧急处理应为静脉补钾（B对）迅速纠正低血钾。口服大剂量β受体阻滞剂（A错）主要作用为阻断甲状腺激素对心脏的兴奋作用、抑制外周组织T4向T3转换；口服甲硫氧嘧啶（C错）为甲亢的基础治疗，也用于手术和¹³¹I治疗前的准备阶段；注射B族维生素（D错）可以帮助维持心脏、神经系统功能；静脉滴注氢化可的松（E错）为甲亢术后出现甲亢危象的紧急处理措施。以上方法虽可治疗甲亢或甲状腺危象，但不能作为对下肢不能活动的紧急处理。